高血压性脑出血最好发的部位是
A. 脑室
B. 基底节
C. 丘脑
D. 脑桥
E. 小脑

正确答案：B。基底节